头孢呋辛用于治疗流行性感冒属于
A. 无适应证用药
B. 超适应证用药
C. 有禁忌症用药
D. 过度治疗用药
E. 盲目联合用药

正确答案：A。无适应证用药

解析：本题考查无适应证用药。头孢呋辛用于治疗流行性感冒属于无适应证用药（A对）。流行性感冒的病原体主要是流感病毒，没有并发细菌感染的症状、体征和证据，因此不应使用处方抗生素。超适应证用药（B错）是指用药超越说明书的适应证范围。有禁忌症用药（C错）是指忽略药品说明书的提示及忽略病情和患者的基础疾病。过度治疗用药（D错）是指滥用抗菌药、糖皮质激素、人血白蛋白、二磷酸果糖及肿瘤补助治疗药，还包括无治疗指征盲目补钙等。盲目联合用药（E错）是指联合应用药物而无明确的指证。